男，7岁。一日前食多量不清洁生黄瓜后突发高热，并迅速出现精神萎靡，面色灰白，四肢厥冷，脉速。大便呈粘液脓血便，镜检有多量脓细胞红细胞和吞噬细胞。最有可能的诊断是
A. 高热惊厥
B. 流行性乙型脑炎
C. 肠结核
D. 中毒性菌痢
E. 肠伤寒

正确答案：D。中毒性菌痢

解析：儿童男性患者，突发高热，并迅速出现一系列全身中毒症状，大便性状为黏液脓血便，镜检见多量脓细胞、红细胞和吞噬细胞，考虑诊断为中毒性菌痢（中毒性细菌性痢疾）（D对）。高热惊厥（A错）、流行性乙型脑炎（B错）和肠结核（C错）一般都无粘液脓血便。肠伤寒（E错）虽然也可出现粘液脓血便，但一般是在病变后期，溃疡侵及小动脉时引起（P359），不会在急性起病时就出现。